阿托品用于解救有机磷酸酯类农药中毒
A. 必须足量、反复使用，必要时使病人达到“阿托品”化
B. 只在严重中毒时才使用
C. 单独使用无效
D. 能迅速制止骨骼肌震颤
E. 合用氯磷定时，应调整阿托品的剂量

正确答案：A、E。必须足量、反复使用，必要时使病人达到“阿托品”化；合用氯磷定时，应调整阿托品的剂量

解析：本题考查有机磷中毒解救。阿托品用于解救有机磷酸酯类农药中毒必须足量、反复使用，必要时使病人达到“阿托品”化（A对）而避免阿托品中毒。阿托品与胆碱酣酶复活剂合用时，阿托品剂量应适当减少（E对）。轻度中毒者，可单用阿托品治疗（BC错）；中度与重度中毒者，则必须与碘解磷定等胆碱酯酶复活剂同时应用。阿托品对烟碱样作用无效，故不能制止肌肉纤维震颤（D错）及抽搐，对呼吸肌麻痹也无效。